中国药典对糖衣片的崩解时限的规定是
A. 15分钟
B. 30分钟
C. 45分钟
D. 1小时
E. 1小时30分钟

正确答案：D。1小时